哪项不是办公场所的基本卫生学要求
A. 办公场所应远离有“三废”污染的工厂
B. 采光照明良好
C. 适宜的小气候
D. 卫生设施齐全，应有上、下水道和其他卫生设施
E. 应保证适宜的办公场所面积（空间）

正确答案：D。卫生设施齐全，应有上、下水道和其他卫生设施

解析：本题考查办公场所的基本卫生学要求。办公场所的基本卫生学要求有：1.办公场所的用地选择：对新建办公场所选址，必须符合城乡总体规划的要求，合理布局。行政机关、写字楼、文化教育等办公场所应远离有“三废”污染的工厂（A对）、企业和有剧毒、易燃、易爆物品的仓库；工业、企业办公场所应与生产区、车间保持一定的距离。2.采光照明良好（B对）：要充分利用自然光线。 在采光不足的办公场所，要保证人工照明的照度，避免眩光。3.适宜的小气候（C对）：要充分利用自然或机械通风设备以及冷暖空调、加湿器等装置，调节办公场所的小气候，以保证使其达到适宜的小气候。4.空气质量良好：避免办公场所室内外污染物对室内空气的污染。5.宽松的环境 应保证适宜的办公场所面积（空间）（E对），安放必要的办公室设备，避免拥挤，防止噪声。卫生设施齐全（D错，为本题正确答案）不是办公场所的基本卫生学要求。